健康传播的概念中不包含
A. 态度和行为改变
B. 医学研究成果转化
C. 降低疾病的患病率和死亡率
D. 提高社区、国家和个人的生活质量
E. 科研成果转化

正确答案：E。科研成果转化